帕金森病患者出现肌紧张过强而运动过少的症状是由于
A. 前庭小脑神经元病变
B. 红核神经元病变
C. 新纹状体γ-氨基丁酸能中间神经元病变
D. 黑质纹状体多巴胺递质系统功能受损
E. 新纹状体胆碱能中间神经元病变

正确答案：D。黑质纹状体多巴胺递质系统功能受损